阴水病位在
A. 脾、肾
B. 肺、肾
C. 肺、脾
D. 心、肾
E. 心、肺

正确答案：A。脾、肾

解析：阴水病因多为饮食劳倦，先天或后天因素所致的脏腑亏损，属里、属虚或虚实夹杂，病程较长，病位在脾、肾（A对）。